对于患有动脉粥样硬化性心脏病同时也是高胆固醇血症的患者，其膳食原则错误的是
A. 限制总能量摄入
B. 脂肪摄入以占总能量20%～25%为宜
C. 胆固醇摄入量应少于300mg/d
D. 饱和脂肪酸的摄入量应低于总能量的7%
E. 反式脂肪酸的摄入量应低于总能量的1%

正确答案：C。胆固醇摄入量应少于300mg/d